抑制磷酸二酯酶Ⅲ的药物是
A. 塞来昔布
B. 地高辛
C. 依那普利
D. 洛伐他汀
E. 米力农

正确答案：E。米力农

解析：本题考查抑制磷酸二酯酶Ⅲ的药物。磷酸二脂酶抑制剂主要通过抑制磷酸二酯酶Ⅲ的活性，升高细胞内cAMP水平，从而产生心收缩力加强和扩张血管作用，如米力农（E对）。塞来昔布（A错）为选择性COX-2环氧酶抑制剂，用于治疗风湿性、类风湿性关节炎和骨关节炎。地高辛（B错）为强心苷类药物。依那普利（C错）为血管紧张素转化酶抑制剂。洛伐他汀（D错）为羟甲基戊二酰辅酶A（HMG-CoA）还原酶抑制剂，用于治疗和防治动脉粥样硬化和冠心病。